“感知自己有可能成为某疾病或危险因素的受害者”，体现了健康信念模式中的
A. 感知行为障碍
B. 感知采纳行为的益处
C. 感知严重性
D. 感知易感性
E. 自我效能

正确答案：D。感知易感性

解析：健康信念模式的基本内容：（1）感知到威胁：对疾病严重性的认识（C错）、对疾病易感性的认识（D对）（2）行为评价（B错）：对行为有效性的认识、对实施或放弃行为的障碍的认识（A错）（3）自我效能（E错）（4）行为线索。因此“感知自己有可能成为某疾病或危险因素的受害者”，体现了健康信念模式中的感知易感性（D对）。